下列疾病中，最可能于凌晨反复出现咳嗽和气短症状的是
A. 慢性肺脓肿
B. 慢性支气管炎
C. 支气管哮喘
D. 肺结核
E. 支气管扩张

正确答案：C。支气管哮喘

解析：支气管哮喘（C对）的临床表现为反复发作的喘息、气急、胸闷或咳嗽等症状，常在夜间及凌晨发作或加重，多数患者可自行缓解或经治疗后缓解（凌晨从睡眠状态向清醒状态切换时，迷走神经兴奋性突然从夜间的低迷转向高兴奋，波动幅度较大，此时对气管收缩作用明显，极易引起支气管哮喘发作）。慢性肺脓肿（A错）有咳嗽、咳脓痰、反复发热及咯血等症状，但无凌晨加重的特点。慢性支气管炎（P20）（B错）多为晨间咳嗽，睡眠时有阵咳或排痰，不是凌晨反复出现。肺结核（P65）（D错）咳嗽较轻，干咳或少量粘液痰，症状无明显周期性变化。支气管扩张（P37）（E错）主要症状为持续或反复的咳嗽、咳痰或咳脓痰，感染时可出现咳嗽加重，痰量增多。